氯丙嗪长期大剂量应用最严重的不良反应
A. 胃肠道反应
B. 中枢抑制症状
C. 锥体外系反应
D. 精神异常
E. 过敏反应

正确答案：C。锥体外系反应

解析：锥体外系反应：长期大量服用氯丙嗪可出现三种反应：①帕金森综合征；②静坐不能；③急性肌张力障碍。掌握“氯丙嗪”知识点。